阴阳不能相互维系，可出现
A. 阳胜则热，阴胜则寒
B. 阳虚则寒，阴虚则热
C. 阴盛格阳，阳盛格阴
D. 阴虚阳亢，阳虚阴盛
E. 阴损及阳，阳损及阴

正确答案：C。阴盛格阳，阳盛格阴

解析：阴阳格拒包括阴盛格阳和阳盛格阴，是指阴或阳将另一方排斥格拒于外，迫使阴阳之间不相维系（C对）。阳胜则热，阴胜则寒是阴阳偏盛的结果（A错）。阳虚则寒，阴虚则热，与阴虚阳亢，阳虚阴盛都是阴阳偏衰的结果（BD错）。阴损及阳，阳损及阴属于阴阳互损（E错）。